除另有规定外，浸膏剂每1g相当于原药材
A. 1g
B. 2～5g
C. 10g
D. 20g
E. 60g

正确答案：B。2～5g